医务人员在长期的医学道德实践中形成和表现出来的稳定心理状态是
A. 医德评价
B. 医德教育
C. 医德品质
D. 医德辩护
E. 医德修养

正确答案：C。医德品质

解析：医务人员在长期的医学道德实践中形成和表现出来的稳定心理状态是医德品质（C对）。